男，4岁，8月10日以“发热腹泻3天，抽搐神志不清4小时”为主诉入院。查体：BP90/60mmHg，P90/分，T39.5℃，神志不清，呼之不应，双侧瞳孔不等大，颈强直，心肺未见异常。化验末梢血WBC21×10⁹/L，N90%，L10%。该患儿应立即给予
A. 糖皮质激素
B. 甘露醇
C. 头孢菌素
D. 哥拉灌肠
E. 多巴胺

正确答案：B。甘露醇

解析：患儿有发热、抽搐、神志不清（意识障碍）的症状；出现脑膜刺激征；实验室检查提示白细胞及中性粒细胞比例均升高，根据以上依据可诊断为化脓性脑膜炎。查体提示双侧瞳孔不等大，提示患儿颅内压升高并且可能存在脑疝，因此应使用甘露醇对症治疗（B对）。